急性乳腺炎最常发生在产后
A. 1个月
B. 3个月
C. 4个月
D. 5个月
E. 6个月

正确答案：A。1个月